乳腺纤维腺瘤的常见肉眼观是
A. 分叶状
B. 乳头状
C. 结节状
D. 囊状泛
E. 菜花状

正确答案：C。结节状

解析：乳腺纤维腺瘤是乳腺最常见的良性肿瘤，通常单个发生，肉眼观呈结节状（C对），与周围组织界限清楚（P302）。肉眼观呈分叶状（A错）可见于脂肪瘤或脂肪肉瘤等疾病（P98-P99）。乳头状癌（B错）是甲状腺癌中最常见的类型（P315）。肉眼观呈囊状（D错）可见于囊腺瘤或囊腺癌等疾病（P97）。肉眼观呈菜花状（E错）可见于宫颈癌等疾病（P286）。